参与Ⅰ型超敏反应的主要细胞是
A. 肥大细胞
B. 致敏T细胞
C. CTL细胞
D. NK细胞
E. 中性粒细胞

正确答案：A。肥大细胞